体现经济发展和居民健康状况的综合指标是
A. 出生率提高
B. 平均期望寿命提高
C. 劳动力的工作时间延长
D. 人均摄入的热量增加
E. 儿童肥胖率提高

正确答案：B。平均期望寿命提高